下列哪种现象不是智齿冠周炎局部检查的常见表现
A. 局部糜烂颗粒状增生似菜花状
B. 挤压龈袋可有脓液溢出
C. 肿胀的龈瓣覆盖低位阻生齿
D. 严重者炎症可波及舌腭弓和咽侧壁
E. 化脓性炎症局限后，可形成冠周脓肿

正确答案：A。局部糜烂颗粒状增生似菜花状

解析：本题考查智齿冠周炎的临床表现。局部糜烂颗粒状增生似菜花状是尖锐湿疣的皮肤黏膜表现（A错，为本题的正确答案）。智齿冠周炎，肿胀的龈瓣覆盖低位阻生齿（C对），挤压龈袋可有脓液溢出（B对），严重者炎症可波及舌腭弓和咽侧壁（D对）。化脓性炎症局限后，可形成冠周脓肿（E对）。